男，42岁。腹部撞伤3小时，持续性腹痛，未排尿。查体：T37.5℃，P110次/分，BP90/60mmHg，腹式呼吸受限，腹稍胀，全腹肌紧张，压痛（+），腹部移动性浊音（+），肠鸣音消失。实验室检查Hb100g/L，WBC12×10⁹/L。最佳治疗方案是
A. 抗休克治疗
B. 急症剖腹探查
C. 广谱抗生素治疗观察
D. 胃肠减压观察
E. 导尿，留置尿管观察

正确答案：B。急症剖腹探查

解析：青年男性患者，腹部外伤后腹痛，腹部压痛、腹肌紧张（腹膜刺激征），腹式呼吸受限，肠鸣音消失（提示腹膜炎），P110次/分（正常为60～90次/分），BP90/60mmHg（正常为90～139/60～89mmHg，已达正常下限），HB100g/L（正常男性为120～160g/L），脉率加快、血压及血红蛋白下降提示失血性休克，腹部移动性浊音（+）（提示腹腔实质性脏器破裂出血），结合患者病史、临床表现和相关检查，应诊断为腹部闭合性损伤，腹腔实质性脏器破裂出血伴休克。由于腹腔实质性脏器破裂出血进展迅速，因此最佳的治疗方案是在抗休克的同时，迅速剖腹探查（B对），以明确出血部位、彻底止血，纠正休克。抗休克治疗（A错）可暂时缓解休克症状，但无法从根本上解除引起失血性休克的原因。应用广谱抗生素（C错）、胃肠减压（D错）及导尿，留置尿管（E错）均为一般性辅助治疗措施，不是该患者的最佳治疗方案。